以下关于口腔流行病学叙述正确的是
A. 利用流行病学的原则、基本原理和方法
B. 研究人群中口腔疾病发生、发展的规律
C. 研究口腔疾病影响因素
D. 可以制定口腔保健计划
E. 以上说法均正确

正确答案：E。以上说法均正确

解析：口腔流行病学即用流行病学的原则、基本原理和方法，研究人群中口腔疾病发生、发展和分布的规律及其影响因素，同时研究口腔健康及其影响因素，为探讨口腔疾病的病因和流行因素、制定口腔保健计划，选择防治策略和评价服务效果打下良好基础。掌握“口腔流行病学概述及研究方法”知识点。